下列有关牛奶含氟浓度正确的是
A. 3～6岁一般为0.1mg/d
B. 3～6岁一般为0.5mg/d
C. 3～6岁一般为1.5mg/d
D. 3～6岁一般为1.8mg/d
E. 3～6岁一般为2.0mg/d

正确答案：B。3～6岁一般为0.5mg/d

解析：牛奶氟化的应用：氟化牛奶可以不同形式生产，如液体奶和奶粉。用于牛奶氟化的氟化物有氟化钠、氟化钙、单氟磷酸钠和硅氟。牛奶含氟浓度可根据饮用者年龄、当地饮水含氟量等适当调整如下：3～6岁一般为0.5mg/d，也有0.75mg/d或1mg/d。掌握“氟的全身及局部应用”知识点。